氧氟沙星左旋体的抗菌活性是右旋体的9.3倍，产生该现象的原因是
A. 构象异构
B. 几何异构
C. 构型异构
D. 组成差异
E. 代谢差异

正确答案：C。构型异构

解析：本题考查药物立体结构对药物效应的影响。氧氟沙星左旋体的抗菌活性是右旋体的9.3倍，产生该现象的原因是构型异构（C对）。构型异构是原子在大分子中不同空间排列所产生的异构现象。包括顺反异构、对映异构（也称为旋光异构）等。氧氟沙星左旋体与右旋体有相似的药理活性，但左旋体的抗菌活性是右旋体的9.3倍的原因是构型异构中的对映异构。构象异构（A错）是指具有一定构型的有机物分子由于碳、碳单键的旋转或扭曲（不是把键断开）而使得分子各原子或原子团在空间产生不同的排列方式的一种立体异构现象。几何异构（B错）是由双键或环的刚性或半刚性系统导致分子内旋转受到限制而产生的。组成差异（D错）、代谢差异（E错）不属于立体结构。